经水厂处理过的水，其水质应达到饮用水卫生标准规定的要求，包括流行病学上安全、感官性状良好和
A. 化学成分正常
B. 有毒化学物质含量正常
C. 矿物质含量丰富
D. 水中化学物质对健康无害
E. 水中不含有毒有害化学成分

正确答案：D。水中化学物质对健康无害

解析：本题考查饮用水卫生标准规定的水质要求。经水厂处理过的水，其水质应达到饮用水卫生标准规定的要求，包括流行病学上安全、感官性状良好和水中化学物质对健康无害（D对ABCE错）。